可导致老年人脱水、低血钾等不良反应的药品是
A. 地西泮
B. 氨氯地平
C. 呋塞米
D. 普萘洛尔
E. 氯苯那敏

正确答案：C。呋塞米

解析：本题考查呋塞米的不良反应。可导致老年人脱水、低血钾等不良反应的药品是呋塞米（C对）。呋塞米为袢利尿药，常见水、电解质紊乱的不良反应，为过度利尿所引起，表现为低血容量（低血压）、低血钾、低血钠、低氯性代谢性碱血症，长期应用还可引起低镁血症，尤其是饮食摄入不足者，补充含有镁盐成分的制剂可以纠正。地西泮（A错）为镇静催眠药，不良反应常见有嗜睡、乏力、记忆力下降、大剂量使用可导致共济失调。氨氯地平（B错）为钙通道阻滞剂，常见不良反应有反射性交感神经激活导致心跳加快、面部潮红、脚踝部水肿、牙龈增生等。普萘洛尔（D错）为β受体阻断药，常见不良反应有疲乏、肢体冷感、激动不安、胃肠不适，长期用药突然停药可发生反跳现象。氯苯那敏（E错）为组胺H₁受体阻断药，常见不良反应有头晕、嗜睡、乏力，驾驶员和高空作业者工作时间不宜使用。还可引起视物模糊、便秘、尿潴留等。其他还有胃肠道反应、恶心、呕吐、腹泻等。